男，2岁。因间断性四肢抽搐就医。1日内无热惊厥发作十数次，脑电图无异常。发作后神志清醒无神经系统症状。查体可见“鸡胸”样畸形和“O”型腿。实验室检查示血钙1.45mmol/L。血镁尿镁正常。最有可能的诊断是
A. 维生素D缺乏性手足抽搐症
B. 低血糖症
C. 低镁血症
D. 婴儿痉挛症
E. 原发性甲状旁腺功能减退

正确答案：A。维生素D缺乏性手足抽搐症

解析：患儿间断性四肢抽搐，无感染病史，无热惊厥，发作后神志清醒无神经系统症状见“鸡胸”样畸形和“O”型腿，血钙1.45mmol/L，低于1.75mmol/L，应诊断为维生素D缺乏性手足拙搐症（A对）。低血糖症（P81）（B错）常发生于清晨空腹时，有进食不足或腹泻史，重症病例惊厥后转入昏迷。低镁血症（P81）（C错）常见于新生儿及年幼婴儿，常有触觉、听觉过敏，引起肌肉颤动，甚至惊厥手足搐搦，血镁常低于0.58mmol/L。婴儿痉挛症（P81）（D错），为癫痫的一种表现，起病于1岁以内，呈突然发作，头及躯干、上肢均屈曲，手握拳，下肢弯曲至腹部，呈点头哈腰状搐搦和意识障碍，发作数秒至数十秒自行停止，伴智能异常，脑电图有特征性高幅异常节律波出现。原发性甲状旁腺功能减退（P82）（E错）表现为间歇性惊厥或手足搐搦，间隔几天或数周发作一次，血磷升高＞3.2mmol/L。